能影响传染病流行的社会因素是
A. 新生儿增加
B. 全球气候变暖
C. 传染病流行
D. 城市流动人口增加
E. 二代发病率增加

正确答案：D。城市流动人口增加